孕2月孕妇，平时体健，昨晚始下腹痛伴出血，量多，今日出血仍多并感头晕，眼花，来医院途中昏倒，急救入院，检查：外阴有大量血迹，阴道内积血块，宫颈口开，内可触及软性胚胎组织，宫体2月妊娠大小，面色苍白，血压9.3/7.3kPa，（70/50mmHg），脉搏120次/分此时最合适的处理是纠正休克的同时应给予
A. 清宫
B. 催产素静脉滴注
C. 维生素K
D. 前列腺素
E. 升压药

正确答案：A。清宫

解析：难免流产一旦确诊，应尽早使胚胎及胎盘组织完全排出。早期流产应及时行负压吸宫术，对妊娠产物进行认真检查，并送病理检查。掌握“自然流产”知识点。